2岁男孩，因智能低下查染色体核型为46，XY，-14，+t（14q21q），查其母为平衡易位染色体携带者，核型应为
A. 45，XX，-14，-21，+t（14q21q）
B. 45，XX，-15，-21，+t（15q22q）
C. 46，XX
D. 46，XX，-14，+t（14q21q）
E. 46，XX，-21，+t（14q21q）

正确答案：A。45，XX，-14，-21，+t（14q21q）

解析：2岁男孩，因智能低下查染色体核型为46，XY，-14，+t（14q21q），由此可知该患儿的染色体核型属于易位型，查其母为平衡易位染色体携带者，故可推知其母亲为14/21平衡易位染色体携带者，因此其核型为45，XX，-14，-21，+t（14q21q）（A对）。而45，XX，-15，-21，+t（15q22q）（B错）为15/22平衡易位染色体携带者，与其子核型不符。46，XX（C错）为正常女性染色体核型，故不选择此项。46，XX，-14，+t（14q21q）（D错）为最常见的D/G易位核型，故不选择此项。46，XX，-21，+t（14q21q）（E错）本身是错误的，故不选择此项。